不属于解表药使用注意的是
A. 不可过汗
B. 不宜久煎
C. 热病津亏者忌服
D. 疮疡初起者忌服
E. 失血兼表证者慎服

正确答案：D。疮疡初起者忌服

解析：本题考查的是解表药的使用注意。久患疮痈者慎服（D错，为本题正确答案）。凡以发散表邪、解除表证为主要功效的药物，称为解表药。发汗力强的解表药在使用时要注意以下几点：掌握用量，中病即止，不可过汗（A对），以免损伤阳气和津液；体虚多汗及热病后期津液亏耗者忌服（C对）；对久患疮痈、淋病及失血的患者，虽有外感表证，也要慎重使用（E对）；入汤剂不宜久煎（B对），以免有效成分挥发过多而降低疗效。